下颌支上端有髁突，又可称为
A. 喙突
B. 翼突
C. 下颌突
D. 关节突
E. 乙状切迹

正确答案：D。关节突

解析：下颌支：又称下颌升支，其上端有喙突和髁突（关节突）。掌握“下颌骨及腭骨解剖特点”知识点。